某村猪群长期食用霉变的玉米后，出现食量下降，生长缓慢，体重较轻和母畜不孕的现象，死后尸检发现肝脏有结节，此种病害最可能是
A. 镰刀菌属中毒
B. 赤霉病麦中毒
C. 黄变米中毒
D. 黄曲霉毒素中毒
E. 展青霉素中毒

正确答案：D。黄曲霉毒素中毒